白果在定喘汤中的作用是
A. 散寒平喘
B. 敛肺定喘
C. 清泻肺热
D. 止咳化痰
E. 降气平喘

正确答案：B。敛肺定喘

解析：本题考查定喘汤的方解。白果敛肺定喘（B对）。散寒平喘为麻黄（A错）。清泻肺热为桑白皮、黄芩（C错）。止咳化痰为苏子、杏仁、半夏、款冬花（C错）。降气平喘为苏子、杏仁、半夏、款冬花（E错）。